情绪可通过哪些系统的生理反应对人体的健康产生影响
A. 呼吸系统、循环系统和泌尿系统
B. 神经系统、循环系统和泌尿系统
C. 呼吸系统、循环系统和免疫系统
D. 神经系统、内分泌系统和免疫系统
E. 呼吸系统、内分泌系统和免疫系统

正确答案：D。神经系统、内分泌系统和免疫系统